能引起羊瘙痒病的病原体是一种
A. 细菌
B. 类病毒
C. 朊病毒
D. 细小病毒
E. 真菌

正确答案：C。朊病毒

解析：朊病毒在人和动物中引起传染性海绵状脑病，为一种潜伏期长，中枢神经系统致死性慢性退化性疾病，如羊瘙痒病及牛海绵状脑病（BSE，即疯牛病）等。掌握“朊粒”知识点。